男，26岁。急起血尿、少尿、水肿、高血压，肾功能急剧恶化。B超双肾增大，肾活检可见70%肾小球的肾小囊中有大新月体形成。下列病例最可能的诊断是
A. 急性链球菌感染后肾小球肾炎
B. 原发性肾病综合征
C. 紫癜性肾炎
D. 急进性肾炎
E. 狼疮性肾炎

正确答案：D。急进性肾炎

解析：青年男性患者，急起血尿、少尿、水肿、高血压（考虑急性肾炎综合征），肾功能急剧恶化。B超双肾增大（急进性肾炎常见的影像学表现），肾活检可见70％肾小球的肾小囊中有大新月体形成（急进性肾炎的典型病理改变）。综合患者的病史、临床表现、影像学检查及病理检查，最可能的诊断是急进性肾炎（D对）。急性链球菌感染后肾小球肾炎（P466）（A错）即急性肾小球肾炎，常见于上呼吸道感染、猩红热、皮肤感染等链球菌感染后，大多预后良好，有自愈性，且病变类型为毛细血管内增生性肾小球肾炎。原发性肾病综合征（P470）（B错）一般均有大量蛋白尿，低白蛋白血症，且病理类型复杂，主要有微小病变型肾病、局灶节段性肾小球硬化、膜性肾病、系膜增生性肾小球肾炎、系膜毛细血管性肾小球肾炎。紫癜性肾炎（P613）（C错）是在皮肤紫癜的基础上，因肾小球毛细血管袢炎症反应而出现血尿、蛋白尿及管型尿，偶见水肿、高血压及肾衰竭等表现。狼疮性肾炎（P481）（E错）是在确诊为系统性红斑狼疮的基础上出现的肾脏损害，可表现为蛋白尿、血尿、管型尿、高血压、肾衰竭等。